诸病胕肿，疼酸惊骇，皆属于
A. 火
B. 热
C. 风
D. 寒
E. 湿

正确答案：A。火

解析：本句意为多种痈肿、疼痛酸楚、惊骇不宁的病证，其病机大都属于火邪所致。由于火热壅滞于血脉，血热肉腐，令患处红肿溃烂、疼痛或酸楚；火热内迫脏腑，扰神则惊骇不宁（A对）。诸胀腹大，皆属于热；诸病有声，鼓之如鼓，皆属于热；诸转反戾，水液浑浊，皆属于热；诸呕吐酸，暴注下迫，皆属于热（B错）。诸暴强直，皆属于风（C错）。诸病水液，澄澈清冷，皆属于寒（D错）。诸痉项强，皆属于湿（E错）。